转氨酶的辅酶是
A. 磷酸吡哆醛
B. 焦磷酸硫胺素
C. 生物素
D. 四氢叶酸
E. 泛酸

正确答案：A。磷酸吡哆醛

解析：转氨酶的辅酶是磷酸吡哆醛（A对）。焦磷酸硫胺素（B错）是ɑ-酮酸氧化脱羧酶的辅酶。生物素（C错）是构成羧化酶的辅基，参与CO₂固定。四氢叶酸（D错）是一碳单位转移的载体。泛酸（E错）主要参与酰基转移反应。